一工人劳动时踏铁钉刺伤足底半日，出血已止，伤口创缘稍肿胀，伤口污染较明显，来院急诊。下列哪项处理是错误的
A. 清创后不予缝合
B. 清创后一期缝合
C. 注射破伤风抗毒素
D. 给予抗菌药物
E. 限制活动，抬高患肢

正确答案：B。清创后一期缝合

解析：污染伤口在清创后行延期缝合，给予抗菌药物，注射破伤风疫苗等措施。掌握“创伤和战伤”知识点。